镜下可以见到由结节状实性细胞巢，形成玫瑰花样结构的肿瘤是
A. 牙源性腺样瘤
B. 牙源性钙化囊性瘤
C. 牙源性角化囊性瘤
D. 单囊型成釉细胞瘤
E. 牙源性钙化上皮瘤

正确答案：A。牙源性腺样瘤

解析：牙源性腺样瘤镜下见肿瘤上皮可形成不同结构：①结节状实性细胞巢，形成玫瑰花样结构。②腺管样结构，③梁状或筛状结构，有时可见由多边形、嗜酸性鳞状细胞组成的小结节。掌握“牙源性腺样瘤、成釉细胞纤维瘤”知识点。